可促进醛固酮分泌的因素是
A. 血Na⁺增多
B. 血K⁺增多
C. 血量增多
D. 血压升高
E. 血管紧张素Ⅱ减少

正确答案：B。血K⁺增多